枕先露妊娠时，胎儿窘迫的诊断依据是
A. 胎动40次/24小时
B. 破膜见羊水粪染
C. 胎心监测示“早期减速”
D. 胎心150次/分
E. 胎儿头皮血pH7.25

正确答案：A。胎动40次/24小时

解析：若胎动计数≥10次/2小时（120次/24小时）为正常，＜10次/2小时（120次/24小时）或减少50%者提示胎儿缺氧可能（A对）；羊水中胎粪污染不是胎儿窘迫的征象（B错）；缺氧早期，胎儿电子监护可出现胎心基线代偿性加快、晚期减速（C错）或重度变异减速，随产程进展，尤其在较强宫缩刺激下胎心基线可下降到＜110bpm（D错）；采集胎儿头皮血进行血气分析，若pH＜7.20，可诊断为胎儿酸中毒（E错）。